枕先露行阴道助产时，确定胎位除注意囟门外，可作为依据的颅缝是
A. 额缝
B. 矢状缝
C. 冠状缝
D. 人字缝
E. 颞缝

正确答案：B。矢状缝

解析：矢状缝（B对）是两顶骨之间的缝，枕先露行阴道助产时，可作为判断先露的部位。